关于腹股沟疝的描述正确的是
A. 斜疝疝块外形多呈半球形
B. 斜疝疝囊颈在腹壁下动脉外侧
C. 直疝精索在疝囊后方
D. 直疝多见于儿童
E. 直疝由直疝三角突出，可进入阴囊

正确答案：B。斜疝疝囊颈在腹壁下动脉外侧

解析：腹股沟疝指发生在腹股沟区（腹股沟韧带、腹直肌外侧缘和平髂前上棘的水平线构成的三角形区域）的腹外疝，分为直疝和斜疝两种。斜疝多见于儿童及青壮年，疝块经腹股沟管突出，呈梨形或椭圆形（A错），可进入阴囊；回纳疝块后压住深环，疝块不再突出；精索在疝囊后方，疝囊颈在腹壁下动脉外侧（B对）；斜疝易发生嵌顿。直疝多见于老年人（D错），疝块由直疝三角突出，呈半球形，很少进入阴囊（E错）；回纳疝块后压住深环，疝块仍可突出；精索在疝囊的前方（C错），疝囊颈在腹壁下动脉内侧；直疝极少发生嵌顿。